药物出现副反应
A. 常发生于剂量过大时
B. 常常可以避免
C. 通常很严重
D. 与药物选择性高低有关
E. 不是由于药物的效应

正确答案：D。与药物选择性高低有关

解析：本题考查药物的不良反应。药物出现副反应与药物选择性高低有关（D对），由于选择性低，药理效应涉及多个器官，当某一效应用作治疗目的时，其他效应就成为副反应（通常也称副作用），是药物固有的效应（E错）；副反应是在治疗剂量下发生的，是药物本身固有的作用，不可避免（B错），多数较轻微（C错）并可以预料。常发生于剂量过大时（A错）见于毒性反应，毒性反应是指在剂量过大或药物在体内蓄积过多时发生的危害性反应，一般比较严重；一般是可以预知的，应该避免发生。